铅中毒时应首先选用
A. 美蓝
B. 亚硝酸钠-硫代硫酸钠
C. 阿托品
D. 依地酸二钠钙
E. 二巯基丙磺酸钠

正确答案：D。依地酸二钠钙